腋动脉第二段
A. 外侧与腋神经相邻
B. 前面仅覆以皮肤和浅筋膜
C. 位于胸小肌前方
D. 内侧有腋静脉和臂丛内侧束
E. 发出肩胛下动脉

正确答案：D。内侧有腋静脉和臂丛内侧束

解析：腋动脉第二段内侧有腋静脉和臂丛内侧束（D对），腋动脉外侧有臂丛外侧束，后方有臂丛后束。